关于低钙血症的临床表现错误的是
A. Chvostek征阳性
B. 手足搐搦
C. 头痛、肌无力
D. 腱反射亢进
E. 口周和指尖麻木及针刺感

正确答案：C。头痛、肌无力

解析：低钙血症时神经肌肉兴奋性升高，出现口周和指（趾）尖麻木及针刺感（E对）、手足抽搐（B对）、腱反射亢进（D对）、Chvostek征阳性（A对），严重时可导致喉、气管痉挛、癫痫发作甚至呼吸暂停。头痛、肌无力（C错）不是低钙血症的临床表现。